紧张反应表现为
A. 躯体不适、心率加快、睡眠不好
B. 心理、生理和行为反应异常
C. 精神紧张、全身不适
D. 血压升高、行为异常
E. 疲劳、倦怠、抑郁、易怒、感情淡漠

正确答案：B。心理、生理和行为反应异常